麻醉药品处方保存期限是
A. 至少2年
B. 至少5年
C. 至少1年
D. 至少3年

正确答案：D。至少3年

解析：本题考查麻醉药品和第一类精神药品的处方资格及处方管理。麻醉药品处方保存期限是至少3年（D对）。处方由调剂处方药品的医疗机构妥善保存。普通处方、急诊处方、儿科处方保存期限为1年（C错），医疗用毒性药品处方保存期限为2年（A错）。医疗机构应当对麻醉药品和精神药品处方进行专册登记，加强管理。麻醉药品处方至少保存3年，精神药品处方至少保存2年。